胰岛β细胞分泌的激素是
A. 胰高血糖素
B. 胰岛素
C. 促胃液素
D. 胰多肽
E. 生长抑素

正确答案：B。胰岛素

解析：胰岛β细胞分泌胰岛素（B对）。胰岛α细胞分泌胰高血糖素（A错）。胃窦、十二指肠G细胞分泌促胃液素（C错）。胰岛、胰腺外分泌部分、胃、小肠、大肠PP细胞分泌胰多肽（D错）。胰岛、胃、小肠、大肠δ细胞分泌生长抑素（E错）。